骨性关节炎治疗中，可以在关节腔注射，但每年最多不超过3～4次的药物是
A. 双氯芬酸
B. 白芍总苷
C. 氨基葡萄糖
D. 曲安奈德
E. 阿达木单抗

正确答案：D。曲安奈德

解析：本题考查骨性关节炎的药物治疗。关节腔注射的药物有：①透明质酸钠；②糖皮质激素；③医用几丁糖；④生长因子和富血小板血浆。曲安奈德（D对）属于糖皮质激素。